医学心理学的研究范围包括
A. 脑与行为的关系
B. 心身关系
C. 心理障碍
D. 医患关系
E. 以上都是

正确答案：E。以上都是